关于牙槽骨不正确的为
A. 分为固有牙槽骨、密质骨和松质骨
B. 是高度可塑性组织
C. 受压侧增生，受牵引侧吸收
D. 可以进行改建
E. 牙槽骨受全身骨代谢的影响

正确答案：C。受压侧增生，受牵引侧吸收

解析：若加一定压力于牙上，一段时间之后，受压侧骨吸收，牙的位置随之移动，而受牵引侧骨质增生，来补偿牙移动后所留下的位置。掌握“牙槽骨”知识点。